用于预防术后切口感染的第二代头孢菌素类药物是
A. 头孢唑林
B. 阿莫西林
C. 头孢呋辛
D. 头孢美唑
E. 头孢曲松

正确答案：C。头孢呋辛

解析：本题考查头孢呋辛的适应症。头孢呋辛（C对）能够用于预防手术后切口感染。